冠状动脉起自
A. 降主动脉
B. 升主动脉
C. 主动脉弓
D. 胸主动脉
E. 主动脉前庭

正确答案：B。升主动脉

解析：升主动脉（B对）为冠状动脉的起始部位，发出左、右冠状动脉。